胃十二指肠急性穿孔最易形成
A. 右膈下脓肿
B. 左膈下脓肿
C. 盆腔脓肿
D. 肠间脓肿
E. 肝脓肿

正确答案：A。右膈下脓肿

解析：空腔脏器穿孔或内脏破裂引发的急性腹膜炎若术后引流不彻底，脓液积聚在腹腔内，由网膜或肠系膜等包裹可形成腹腔脓肿。腹腔脓肿可分为膈下脓肿、盆腔脓肿和肠间脓肿。病人术后多处于平卧位，此时膈下部位最低，脓液易积聚于此处形成膈下脓肿。脓肿的位置还与原发病有关。由于十二指肠穿孔多发生在右侧肝下的球部，因此术后引流不畅易形成右膈下脓肿；而胃位于腹腔左侧，穿孔多发生在小弯侧，因此术后引流不畅易发生左侧膈下脓肿。依照九版外科学，本题无正确答案，原参考答案为A。盆腔脓肿（C错）（P334）多继发于下腹部和盆腔脏器感染、弥漫性腹膜炎或腹部手术后，如阑尾穿孔、结直肠手术后。肠间脓肿（D错）指脓液被包围在肠管、肠系膜与网膜之间的脓肿，主要继发于弥漫性腹膜炎。常见的肝脓肿（E错）有细菌性肝脓肿和阿米巴性肝脓肿，细菌性肝脓肿多继发于化脓性胆管炎、化脓性骨髓炎、坏疽性阑尾炎等严重的感染性疾病；阿米巴性肝脓肿是肠道阿米巴感染的并发症，与胃十二指肠穿孔无关。